男性，35岁。海上作业为主，今日发热，体温38.5℃，腹泻稀便。查：周身可见荨麻疹，无黄疸，肝肋下1.0cm，脾肋下2.0cm。实验室检查白细胞15×10⁹/L，嗜酸性粒细胞40%。其最可能的诊断为
A. 伤寒
B. 副伤寒
C. 阿米巴肝脓肿
D. 急性血吸虫病
E. 粟粒性结核

正确答案：D。急性血吸虫病